以下疾病通常不会表现为唇部糜烂的是
A. 慢性唇炎
B. 盘状红斑狼疮
C. 多形性红斑
D. 增值型天疱疮
E. 大疱性类天疱疮

正确答案：E。大疱性类天疱疮

解析：本题考查不会表现为唇部糜烂的口腔黏膜病。以下疾病通常不会表现为唇部糜烂的是大疱性类天疱疮（E错，为本题的正确答案）。大疱性类天疱疮以躯干、四肢出现张力性大疱为特点，常见于60岁以上老年人，皮肤黏膜水疱尼氏征阴性，因口腔较少受累且水疱破后易于愈合，一般不发生唇部糜烂。慢性唇炎（A错）可分为以脱屑为主的慢性脱屑性唇炎和以渗出糜烂为主的慢性糜烂性唇炎，慢性糜烂性唇炎可表现为上下唇红部反复糜烂，渗出明显，结痂剥脱。盘状红斑狼疮（B错）的好发部位是下唇唇红黏膜，初起为暗红色丘疹或斑块，随后形成红斑样病损，片状糜烂，唇红糜烂易发生溢血而形成血痂。多形性红斑（C错）口腔病损好发于唇、颊、舌、腭等部位，黏膜充血水肿，有时可见红斑及水疱，但疱很快破溃，故最常见的病变为唇部大面积糜烂，病损易出血，在唇部常形成较厚的黑紫色血痂。增值型天疱疮（D错）在口腔内及可出现大小不等的水疱，尼氏征阳性，水疱易破，出现不规则的糜烂面，糜烂面易感染，长期的糜烂面存在使患者咀嚼、吞咽甚至说话均有困难，唇红缘常有显著的增值，可有糜烂。